根据《中华人民共和国反不正当竞争法》下列情形不属于“不正当竞争行为”的是
A. 招标者与投标者相互串通抬高标价的
B. 低于成本价处理有效期即将到期的商品的
C. 以歧视性语言进行商品宣传的
D. 地方政府限制外地商品进入本地市场的

正确答案：B。低于成本价处理有效期即将到期的商品的

解析：本题考查不属于不正当竞争行为的界定。不属于不正当竞争行为：①销售鲜活商品。②处理有效期限即将到期的商品或者其他积压的商品（B错，为本题正确答案）。③季节性降价。④因清偿债务、转产、歇业降价销售商品。